哪一项不是阿司匹林的不良反应
A. 胃黏膜糜烂及出血
B. 出血时间延长
C. 溶血性贫血
D. 诱发哮喘
E. 血管神经性水肿

正确答案：C。溶血性贫血